青春期早期的主要表现
A. 生长突增阶段，骨骼系统发育迅速
B. 女孩乳房发育，男孩睾丸增大
C. 阴毛、腋毛开始发育
D. 性腺开始发育
E. 性激素呈脉冲式释放

正确答案：A。生长突增阶段，骨骼系统发育迅速

解析：本题考查青春期的分期特点。青春期可分为青春早期、中期、后期，青春早期的身高生长突增，骨骼系统发育迅速（A对）,随着体格快速生长、第二性征出现,生殖系统迅速发育；青春中期女孩乳房发育，男孩睾丸增大（B错），腋毛、阴毛开始出现（C错），性腺开始发育（D错）；青春晚期性激素呈脉冲式释放（E错）。